男，7岁。发热、头痛、恶心、呕吐2天，嗜睡1天。查体：T39.5℃，浅昏迷，曈孔等大，对光反射存在，腹部多个出血点，颈抵抗（+），克氐征（+）。实验室检查
A. 结核性脑膜炎
B. 流行性脑脊髓膜炎
C. 流行性乙脑炎
D. 中毒型细菌性痢疾
E. 肾综合征出血热

正确答案：B。流行性脑脊髓膜炎

解析：患者男性儿童。发热、头痛、恶心、呕吐2天，嗜睡1天（脑膜炎表现）。查体：T39.5℃，浅昏迷，曈孔等大，对光反射存在（脑型中毒性菌痢出现中枢神经系统症状时瞳孔不等大，对光反射消失，排除D选项），腹部多个出血点（败血症表现），颈抵抗（+），克氏症（+）（脑膜刺激征阳性），根据患者年龄、症状和体征等表现，诊断为流行性脑脊髓膜炎（B对）（P207-P208）。结核性脑膜炎（A错）可表现为头痛、呕吐、意识障碍等表现，但一般为继发于肺部初次感染后的继发感染，该患者没有相关病史，亦缺少结核毒性症状，如午后潮热、倦怠无力、盗汗、食欲减退和体重减轻等（P215）。流行性乙型脑炎（C错）是由乙型脑炎病毒引起的以脑实质炎症为主要病变的中枢神经系统急性传染病，临床上以高热、意识障碍、惊厥或抽搐、呼吸衰竭、病理反射及脑膜刺激征为特征（与患者表现不符）（P86）。中毒型细菌性痢疾（D错）以2-7岁儿童为多见，起病急骤，突起畏寒、高热，临床以严重毒血症状、休克和（或）中毒性脑病为主，发病24小时内可出现痢疾样粪便（本题患者无消化道症状），其中脑型中毒型细菌性痢疾以中枢神经系统症状为主要临床表现，患者可出现剧烈头痛、频繁呕吐、烦躁、惊厥、昏迷，但查体可见瞳孔不等大、对光反射消失（与本题患者表现不符）（P77）。肾综合征出血热（E错）又称流行性出血热，主要病理变化是全身小血管和毛细血管广泛性损害，临床上以发热、低血压休克、充血出血和肾损害为主要表现（该患者无此表现）（P77）。